两侧球状突中央部分未联合或部分联合形成的是
A. 完全性唇裂
B. 不完全性唇裂
C. 上唇正中裂
D. 下唇裂
E. 综合征性唇裂

正确答案：C。上唇正中裂

解析：本题考查面部发育异常。两侧球状突中央部分未联合或部分联合形成的是上唇正中裂（C对），由于唇的发育与前颌骨及腭的发育有关，所以唇裂常伴有切牙和尖牙间的颌裂及腭裂，两侧球状突中央部分未联合或部分联合形成的是上唇正中裂，两侧下颌突在中线处未融合形成的是下唇裂（D错），这两种唇裂罕见。唇裂（cleflip），多见于上唇，是球状突和上颌突未融合或部分融合所致，发生在唇的侧方,单、双侧均可发生，单侧者较多。依病变程度可分为完全性和不完全性两种。从唇红至前鼻孔底部完全裂开为完全性唇裂（A错）；只在唇红缘有一个小切迹为不完全性唇裂（B错）。综合性唇裂（E错）为一些面部发育异常性综合征可伴发唇裂。